寿胎丸的药物组成
A. 菟丝子、桑寄生、续断、杜仲
B. 菟丝子、续断、黄芩、白术
C. 菟丝子、续断、阿胶、白术
D. 菟丝子、续断、桑寄生、阿胶
E. 桑寄生、续断、黄芪、白术

正确答案：D。菟丝子、续断、桑寄生、阿胶

解析：寿胎丸的药物组成为菟丝子、续断、桑寄生、阿胶（D对）。方歌：寿胎丸中用菟丝，寄生续断阿胶施。妊娠中期小腹痛，固肾安胎此方咨。